蛋白质分子中氨基酸的排列顺序决定因素是
A. 氨基酸的种类
B. tRNA
C. 转肽酶
D. mRNA分子中单核苷酸的排列顺序
E. 核糖体

正确答案：D。mRNA分子中单核苷酸的排列顺序